下列哪种是被动免疫的生物制品
A. 伤寒菌苗
B. 卡介苗
C. 流感疫苗
D. 破伤风抗毒素
E. 白喉类毒素

正确答案：D。破伤风抗毒素